与糖尿病患者酸中毒有关的主要代谢途径是
A. 糖原合成
B. 尿酸合成
C. 糖原分解
D. 丙酮酸羧化
E. 酮体生成

正确答案：E。酮体生成

解析：糖尿病酸中毒首先考虑糖尿病酮症酸中毒，其为糖尿病最常见的并发症。机体因为糖利用障碍导致体内糖含量过多，在代谢过程中相当一部分转化为酮体，导致酮症，因为酮体中含有酸性成分，使机体出现酸碱平衡紊乱，导致酸中毒。酮体生成（E对）为糖尿病患者酸中毒的主要代谢途径。糖原合成（A错）指在糖原合酶的催化下活化形式的葡糖糖与引物分子合成糖原的过程，不会导致体内酸生成过多。尿酸合成（B错）是嘌呤的代谢过程，与糖尿病无关。糖原分解（C错）是糖原分解为葡萄糖补充血糖的过程，也不会出现酸中毒，且糖尿病患者体内糖含量增多，抑制糖原分解（九版生物化学与分子生物学P108）。丙酮酸羧化（D错）不是糖尿病导致的代谢问题，且糖尿病患者糖利用存在障碍，体内不会生成过多的丙酮酸。